采收加工中，晒至六七成干，轻轻捶扁，再晒干的药材是
A. 续断
B. 巴戟天
C. 羌活
D. 藁本
E. 胡黄连

正确答案：B。巴戟天

解析：本题考查的是巴戟天的采收加工。采收加工中，晒至六七成干，轻轻捶扁，再晒干的药材是巴戟天（B对）。巴戟天：【采收加工】全年均可采挖，除去须根及泥土，洗净，晒至六七成干，轻轻捶扁，晒干。续断（A错）：【采收加工】秋季采挖，除去根头和须根，用微火烘至半干，堆置“发汗”至内部变绿色时，再烘干。羌活（C错）：【采收加工】春、秋二季采挖，除去须根及泥沙，晒干。藁本（D错）：【采收加工】秋季茎叶枯萎或次春出苗时采挖，除去泥沙，晒干或烘干。胡黄连（E错）：【采收加工】秋季采挖，除去须根和泥沙，晒干。